女性第二性征在何年龄发育应考虑有性早熟问题
A. 8岁以前
B. 9岁
C. 11岁
D. 13岁
E. 15岁

正确答案：A。8岁以前